一位初产妇，妊娠39周，产前检查5次，妊娠经过顺利。今晨1时出现阵发性腹痛，不能入睡，坚持到早上8时到当地妇幼保健院就诊，门诊以妊娠足月临产收入院。入院后检查宫缩每5～6分钟一次，持续25~30秒，枕左前位，宫颈口开大2cm，余正常。该产妇产程属于
A. 潜伏期
B. 活跃期
C. 活跃晚期
D. 第二产程
E. 第三产程

正确答案：A。潜伏期